某男，70岁。咳嗽气喘多年，兼见尿频尿多。证属肺气不敛，宜选用的药是
A. 瓜蒌
B. 枇杷叶
C. 芥子
D. 桑白皮
E. 白果

正确答案：E。白果

解析：本题考查的是白果的主治病证。咳嗽气喘多年，兼见尿频尿多。证属肺气不敛，宜选用的药是白果（E对）。白果：【主治病证】（1）咳喘气逆痰多。（2）白浊，带下，尿频、遗尿。瓜蒌（A错）：【主治病证】（1）肺热咳嗽、痰稠不易咳出。（2）胸痹，结胸。（3）乳痈肿痛，肺痈，肠痈。（4）肠燥便秘。枇杷叶（B错）：【主治病证】（1）肺热之咳喘痰稠。（2）胃热之烦渴、呕哕。芥子（C错）：【主治病证】（1）寒痰咳喘，悬饮胁痛。（2）痰阻经络之肢体关节疼痛，阴疽流注。桑白皮（D错）：【主治病证】（1）肺热之咳喘痰多。（2）浮肿尿少，小便不利。